下列属于牙尖交错位的影响因素的是
A. 牙尖交错（牙合）异常
B. 颞下颌关节异常
C. 肌功能异常
D. A+B
E. A+B+C

正确答案：E。A+B+C

解析：牙尖交错位的影响因素：①牙尖交错（牙合）异常；②肌功能异常；如一侧咬肌痉挛，可使下颌在牙尖交错位时出现偏斜，上下牙不能达到最广泛、最紧密的接触；③颞下颌关节异常；如髁突发育异常、髁突重度骨质吸收、下颌骨骨折移位等，都会造成咬合接触的异常，上下颌牙不能达到最广泛、最紧密的接触。上下牙的牙尖交错位是不稳定的，它会因（牙合）面磨耗，牙齿位置的改变以及牙齿的缺失等，产生适应性的改变。掌握“牙尖交错位、后退接触位与正中关系”知识点。